七情内伤致病多损伤的脏腑是
A. 心肝脾
B. 心肺脾
C. 心肝肾
D. 心肺肝
E. 肺脾肾

正确答案：A。心肝脾

解析：本题考察七情内伤的致病特点。因心为五脏六腑之大主，故七情过激伤人发病，首先作用于心神；肝主疏泄，调畅气机，在调节情志活动，保持心情舒畅方面发挥着重要作用；脾在志为思，思虑、记忆等精神活动皆与脾密切相关，因此情志内伤，最易损伤心肝脾三脏（A对）。